麻醉药品标签上的标志应为
A. 绿、白
B. 蓝、白
C. 黑、白
D. 红、黄
E. 黄、白

正确答案：B。蓝、白

解析：本题考查麻醉药品标签上的标志。麻醉药品标签上的标志应为蓝、白（B对）。根据《药品管理法》及相关规定，麻醉药品和精神药品的标签必须印有国务院药品监督管理部门规定的标志。国务院药品监督管理部门规定的麻醉药品专用标志样式为天蓝色与白色相间的图案，精神药品的专用标志样式为绿色与白色（A错）相间的图案。